患者，男性，59岁，3个月来出现间断无痛性肉眼血尿。起病来一般状态好，轻度贫血貌，双肾未触及。该患者首先考虑的诊断是
A. 尿路感染
B. 膀胱结石
C. 泌尿系结核
D. 前列腺增生症
E. 泌尿系肿瘤，以膀胱肿瘤可能性大

正确答案：E。泌尿系肿瘤，以膀胱肿瘤可能性大